止带方适用于带下病的哪种证候
A. 肾阳虚
B. 肾阴虚
C. 脾虚
D. 湿热
E. 湿毒

正确答案：D。湿热

解析：止带方专用于止带，功能清热利湿止带，故用于带下病带下过多。带下过多肾阳虚证方选内补丸（A错）。带下过多肾阴虚证多夹湿，方选知柏地黄丸（B错）。带下过多脾虚证方选完带汤（C错）。带下过多湿热下注证方选止带方（D对）。带下过多热毒蕴结证方选五味消毒饮（E错）。